可以出现多个牙松动及下唇麻木的颌骨骨髓炎是
A. 急性中央性骨髓炎
B. 慢性硬化骨髓炎
C. 边缘性骨髓炎
D. 放射性骨髓炎
E. 新生儿骨髓炎

正确答案：A。急性中央性骨髓炎

解析：本题考查出现多个牙松动及下唇麻木的颌骨骨髓炎。急性中央性骨髓炎（A对）受累区多个牙松动，下颌的炎症可沿下颌神经管扩散，使下牙槽神经受损，出现下唇麻木。慢性硬化骨髓炎（B错）主要表现为颌周间隙肿胀，局部组织坚硬，轻微压痛，无波动感；炎症侵犯咬肌或翼内肌，张口明显受限。边缘性颌骨骨髓炎（C错）系指继发于骨膜炎或骨膜下脓肿的骨密质外板的炎性病变，常在颌周间隙感染基础上发生。放射性骨髓炎（D错）为初期持续性针刺样剧痛，黏膜或皮肤破溃，牙槽突、骨面外露，继发感染部位长期溢脓，久治不愈，患者有放射治疗史。新生儿骨髓炎（E错）以全身症状为主，牙尚未萌出。